女，50岁，对称性多关节肿痛3年，晨僵2小时，实验室检查：RF阳性，双手X线片示近端指间关节面虫蚀样改变，关节间隙狭窄。可用于治疗该患者的药物是
A. 维拉帕米
B. 头孢菌素
C. 青霉素
D. 维生素C
E. 来氟米特

正确答案：E。来氟米特

解析：中老年女性患者，对称性多关节肿痛、晨僵（晨起明显，活动后减轻，持续时间超过1小时者意义较大），RF阳性，双手X线片示近端指间关节面虫蚀样改变，关节间隙狭窄。应首先考虑的诊断是类风湿关节炎。治疗RA的常用药物分为五大类，即非甾体抗炎药（NSAIDs）、传统DMARDs、生物DMARDs、糖皮质激素（GC）及植物药等。初始治疗必须应用一种DMARDs。来氟米特（E对）属于传统DMARDs。